医疗机构麻醉药品处方的最低保存年限是
A. 1年
B. 2年
C. 3年
D. 4年
E. 5年

正确答案：C。3年

解析：在医疗机构，麻醉药品处方的最低保存年限是3年，精神药品处方至少保存2年（C对ABDE错）。